肠系膜上动脉根部阻塞时不出现血运障碍
A. 盲肠、阑尾
B. 空、回肠
C. 升结肠
D. 横结肠
E. 降结肠

正确答案：E。降结肠

解析：当肠系膜上动脉根部阻塞时，盲肠、阑尾（A对）、空、回肠（B对）、升结肠（C对）、横结肠（D对）均会出现血运障碍。而当肠系膜下动脉根部阻塞时，降结肠（E错，为本题正确答案）才会出现血运障碍。